关于水溶性维生素与脂溶性维生素的正确描述是
A. 前者比后者易储存于体内
B. 大量摄入后，前者有毒性，后者没有
C. 前者易被氧化，后者不会
D. 前者存在于植物性食物，后者存在于动物性食物
E. 前者缺乏时出现症状快，后者慢

正确答案：E。前者缺乏时出现症状快，后者慢